肿瘤细胞被细胞毒性T细胞杀伤的关键条件是
A. 表达黏附分子
B. 表达MHCⅠ类分子
C. 表达CD分子
D. 分泌细胞因子
E. 表达MHCⅡ类分子

正确答案：B。表达MHCⅠ类分子

解析：细胞毒性T细胞通过细胞表面的T细胞受体识别与MHCⅠ类分子（B对E错）组成复合物的肿瘤特异性抗原而激活，进而杀伤肿瘤细胞。表达黏附分子（A错）主要作用在于白细胞边集和滚动。表达CD分子（C错）常见于肿瘤细胞的表达。T细胞产生的细胞因子干扰素-γ可激活巨噬细胞产生肿瘤坏死因子（TNF-α），辅助巨噬细胞杀伤肿瘤细胞，不是肿瘤细胞被细胞毒性T细胞杀伤的关键（D错）。